关于三羧酸循环的叙述，错误的是
A. 是糖、脂、蛋白质三大营养素分解的共同途径
B. 三羧酸循环还有合成功能，提供小分子原料
C. 生糖氨基酸须经三羧酸循环的环节转变成糖
D. 氧化1分子乙酰CoA时，可提供4对氢原子
E. 三羧酸循环也是营养素生成乙酰CoA的途径

正确答案：E。三羧酸循环也是营养素生成乙酰CoA的途径